T细胞活化的第一信号来源于
A. 细胞因子
B. TCR识别结合在MHC分子槽中的抗原肽
C. TCR识别MHC分子
D. TLR识别LPS
E. 共刺激分子提供的信号

正确答案：B。TCR识别结合在MHC分子槽中的抗原肽